问病情不包括
A. 寒热
B. 头身
C. 饮食
D. 二便
E. 预防接种史

正确答案：E。预防接种史

解析：问病情包括询问疾病的症状及持续时间，病程中的病情变化和发病的原因。①问寒热主要问寒热的微甚进退，发作时辰与持续时间、温度高低，最好用体温计测量并记录（A对）；②问出汗；③问头身婴幼儿头痛常表现为反常哭闹，以手击头或摇头，较大儿童能诉说头痛、头晕及身体其他部位的疼痛和不适（B对）；④问胸腹；⑤问二便患儿大小便的数量、性状、颜色、气味及排便时的感觉等情况，有些可从望诊、闻诊中获悉，通常是通过问诊了解（D对）；⑥问饮食饮食包括纳食和饮水两方面（C对）；⑦问睡眠小儿睡眠情况，要询问每日睡眠时间，睡中是否安宁，有无惊惕、惊叫、啼哭等。问预防接种史属于问个人史，不属于问病情（E错，为本题正确答案）。